男婴，8个月。腹泻伴呕吐3天，无尿6小时。大便10-15次/天，呈蛋花汤样伴黏液，有腥臭味。查体：T37.8C，表情淡漠，前囟、眼窝明显凹陷，皮肤弹性差，可见花纹，四肢厥冷，双肺呼吸音清，心率120次/分，腹软，无明显压痛。实验室检查：粪镜检偶见白细胞，血钠134mmol/L。首批快速扩容静脉输液应给予
A. 1/3张含钠液
B. 2：1等张含钠液
C. 2/3张含钠液
D. 1/2张含钠液
E. 4/5张含钠液

正确答案：B。2：1等张含钠液

解析：婴幼儿，腹泻伴呕吐3天，无尿6小时（提示重度脱水），大便10-15次/天，呈蛋花汤样伴黏液，有腥臭味，查体：T37.8℃（正常值为36℃～37℃，提示发热），表情淡漠，前囟、眼窝明显凹陷，皮肤弹性差，可见花纹，四肢厥冷（重度脱水的典型临床表现），双肺呼吸音清，心率120次/分（正常值为60～100次/分，心率增快），腹软，无明显压痛，实验室检查：粪镜检偶见白细胞，血钠134mmol/L（正常值为130～150mmol/L，提示等渗脱水），根据患儿的症状、体征及实验室检查，考虑最可能的诊断为腹泻病伴有重度等渗脱水，重度脱水时的静脉补液时首批快速扩容静脉输液应给予第2：1等张含钠液（B对），可明显改善循环。